患者，男，40岁。咳嗽气促，咳痰量多，痰质粘稠而黄，咯吐不爽，胸胁胀满，面赤身热，口干，舌红苔黄腻，脉滑数。治疗应首选
A. 止嗽散
B. 桑菊饮
C. 二陈汤
D. 清金化痰汤
E. 加减泻白散

正确答案：D。清金化痰汤

解析：根据“咳嗽气促，咳痰量多”可知病为“咳嗽”；根据“痰质粘稠而黄，咯吐不爽，胸胁胀满，面赤身热，口干，舌红苔黄腻，脉滑数”可辨为“痰热郁肺证”，治宜清热化痰，肃肺止咳，代表方为清金化痰汤（D对）。止嗽散为外感咳嗽之风寒袭肺证的代表方（A错）。桑菊饮为外感咳嗽之风热犯肺证的代表方（B错）。二陈汤为喘证之痰浊阻肺证的代表方（C错）。加减泻白散为内伤咳嗽之肝火犯肺证的代表方（E错）。